细胞增生程度除用³H-TdR参入法外，还可应用的检测方法是
A. 乳酸脱氢酶释放法
B. MTT法
C. ELISA法
D. 溶血空斑试验
E. ELISOP法

正确答案：B。MTT法